男，20岁，感冒后7天出现颜面及双下肢浮肿，尿少。查：血压160/100mmHg，尿蛋白++，尿沉渣：红细胞++，SCr130μmol/L。2周后少尿，BUN28mmol/L，SCr620μmol/L，哪种疾病可能性大
A. 急性肾小球肾炎
B. 急进性肾小球肾炎
C. 慢性肾炎
D. 肾病综合征
E. 高血压肾病

正确答案：B。急进性肾小球肾炎

解析：青年男性患者，感冒后（急进性肾小球肾炎常有前驱呼吸道感染症状）7天出现颜面及双下肢浮肿（提示水肿）、尿少（提示肾功能减退）。查：血压160/100mmHg（正常为90～130/60～90mmHg，提示有高血压），尿蛋白++（正常尿蛋白阴性，提示有蛋白尿），尿沉渣：红细胞++（正常为阴性，提示有血尿），Scr130μmol/L（正常为88.4～176.8μmol/L），其中血尿、蛋白尿、水肿、高血压为急性肾炎综合征的表现。2周后少尿（＜400ml/d），BUN28mmol/L（正常为3.2～7.1mol/L，提示有氮质血症），Scr620μmol/L（正常为88.4～176.8μmol/L，提示血肌酐明显升高），氮质血症、血肌酐明显升高，提示肾功能在2周内急剧恶化，2周后出现少尿，考虑患者已经达到少尿性急性肾衰竭。综合患者的病史、临床表现、实验室检查，考虑急进性肾小球肾炎（B对）可能性最大。急性肾小球肾炎（P466）（A错）一般为自限性疾病；慢性肾炎（P478）（C错）病程需持续三个月以上，且早期无明显临床症状；肾病综合征（P470）（D错）主要表现为大量蛋白尿（＞3.5g/d）、低白蛋白血症（Alb＜30g/L）伴（不伴）水肿和高脂血症；高血压肾病（P250）（E错）为长期持续高血压导致的肾实质损伤，以上疾病多不会出现短期内肾功能进行性恶化的表现。